下列属于小儿的婴儿期的是
A. 自出生后至满1周岁前
B. 从受精卵形成到胎儿出生
C. 自胎儿娩出脐带结扎至28天
D. 自1岁满3周岁之前
E. 自3周岁至6～7岁入小学前

正确答案：A。自出生后至满1周岁前

解析：婴儿期是指出生到1周岁之前（A对）。从受精卵形成到胎儿出生是胎儿期（B错）。自胎儿娩出脐带结扎至28天是新生儿期（C错）。自1岁满3周岁之前是幼儿期（D错）。自3周岁至6~7岁入小学前是学龄前期（E错）。